关于室间隔的说法何者正确
A. 分隔左、右心室
B. 由心肌及覆盖心肌的心内膜构成
C. 分隔左心室和右心房、右心室
D. 呈矢状位
E. 无上述情况

正确答案：A。分隔左、右心室

解析：室间隔分隔左、右心室（A对），又称室中隔，分为肌部和膜部两部分。